上颌前磨牙的髓室形态中哪项正确
A. 近远中径大于唇舌径
B. 近远中径大于（牙合）龈径
C. 近远中径大于颊舌径
D. （牙合）龈径大于唇舌径
E. 颊舌径大于近远中径

正确答案：E。颊舌径大于近远中径

解析：本题考查恒前牙、恒前磨牙的髓腔形态及应用解剖。上颌前磨牙的髓腔形态：髓室似立方形，颊舌径大于近远中径（E对AC错）。髓室位于牙冠颈部及根柱内，合龈距离＜近远中径＜颊舌径（BD错）。髓室顶中部凸向髓腔，最凸处约与颈缘平齐。髓室顶上有颊舌两个髓角。